下列哪项不属于食品的是
A. 供人食用的原料
B. 供人食用的成品
C. 供人饮用的成品
D. 以治疗为目的的物品
E. 既是食品又是药品的物品

正确答案：D。以治疗为目的的物品